用于吞噬细胞吞噬功能测定的实验是
A. ³H-TdR参入法
B. ELISA
C. 免疫PCR
D. MTT法
E. 硝基蓝四氮唑实验

正确答案：E。硝基蓝四氮唑实验